元气
A. 上荣于目
B. 上出息道，下走气街
C. 熏于肓膜，散于胸腹
D. 通于三焦，流行全身
E. 与血同行，环周不休

正确答案：D。通于三焦，流行全身

解析：元气通过三焦，流行于全身。《难经·六十六难》说：“三焦者，元气之别使也，主通行三气，经历于五脏六腑（D对）。”肝气上荣于目（A错）。宗气聚于胸中，通过上出息道，贯注心脉及沿三焦下行方式布散全身。同时《灵枢·刺节真邪》中还指出宗气可由气海向下注入气街（B错）。《素问·痹论》：“卫者，水谷之悍气也。其气慓疾滑利，不能入于脉也。故循皮肤之中，分肉之间，熏于肓膜，散于胸膜”（C错）。《素问·痹论》：“营者，水谷之精气也。和调于五脏，洒陈于六腑。故循脉上下，贯五脏，络六腑也。”可见营气由水谷之精所化生，进入脉中，循脉全身，内入脏腑，外达肢节，终而复始，营周不休（E错）。